患儿女，1岁。生后2个月查体发现心脏杂音。平素呼吸略促，吃奶量少、慢，吃奶后多汗。曾患肺炎2次伴心力衰竭。查体：体重7kg，呼吸40次/min，心率130次/min，律齐，心音有力，胸骨左缘第3～4肋间可闻及3～5/6级粗糙的全收缩期杂音，传导广泛，可触及震颤，肺动脉瓣第2音亢进。最可能的诊断是
A. 房间隔缺损
B. 室间隔缺损
C. 动脉导管未闭
D. 法洛四联症
E. 肺动脉狭窄

正确答案：B。室间隔缺损